在进行毒理学安全性评价之前，了解受试物的挥发性的目的是
A. 可以确定吸入毒性
B. 可判断经呼吸道染毒的必要性
C. 有助于呼吸道染毒剂量的设计
D. 有助于呼吸道染毒时染毒方法的选择
E. 有助于防止呼吸道染毒时的交叉吸收

正确答案：B。可判断经呼吸道染毒的必要性